主要用于结扎血管和缝合，是重要的基本功，也是最基本的技术操作之一的是
A. 组织分离技术
B. 打结
C. 缝合
D. 止血
E. 组织切开

正确答案：B。打结

解析：打结是重要的手术基本功，是最基本的技术操作之一，主要用于结扎血管和缝合。掌握“口外手术打结、缝合及外科引流”知识点。